鸡内金的功效有
A. 化痰止咳
B. 运脾消食
C. 固精止遗
D. 化坚消石
E. 破气散结

正确答案：B、C、D。运脾消食；固精止遗；化坚消石